女性，13岁。左上前牙突然出现明显的咬合痛、自发痛3天。口腔检查：恒牙，牙周检查（-），左上2叩诊（++），舌面窝处深龋，探诊（-）。最可能的病因是
A. 牙隐裂
B. 畸形中央尖
C. 畸形舌侧窝
D. 畸形舌侧尖
E. 牙中牙

正确答案：C。畸形舌侧窝

解析：本题考查畸形舌侧窝。女性，13岁。左上前牙突然出现明显的咬合痛、自发痛3天。口腔检查：恒牙，牙周检查（-），左上2叩诊（++），舌面窝处深龋，探诊（-）。最可能的病因是畸形舌侧窝（C对）。左上前牙突然出现明显的咬合痛、自发痛3天，左上2叩诊（++），探诊（-），可诊断为根尖周炎，舌面窝处深龋，可得出是由畸形舌侧窝引起的根尖周炎。牙隐裂的症状有激发痛，咬合痛，自发痛；凡症状类似牙髓炎、根尖周炎的患牙，叩痛明显，但未发现龋坏、缺损等牙体硬组织疾病时，应考虑牙隐裂的可能，该患牙舌面窝处深龋，应排除（A错）。畸形中央尖多发生在（牙合）面中央窝，常呈对称发生，且下颌第二前磨牙多见（B错）。畸形舌侧尖位于舌隆突的圆锥形突起（D错）。牙中牙呈圆锥形，较其固有形态稍大（E错）。